下列哪种嗜好是口腔白色角化病的刺激因素
A. 吸烟
B. 酗酒
C. 喜食辛辣
D. 喜食过热饮食
E. 喜食脆、硬食物

正确答案：A。吸烟

解析：本题考查口腔白色角化病的刺激因素。口腔白色角化病由长期的机械性或化学性刺激所引起，以牙齿的残根、残冠，不良修复体或吸烟（A对）等刺激因素最为常见。发生在硬腭黏膜及其牙龈，呈弥漫性分布的、伴有散在红点的灰白色或浅白色病变，多是由于长期吸烟所造成的，因而又称为烟碱性或尼古丁性白色角化病。酗酒（B错）、喜食辛辣（C错）、喜食过热饮食（D错）、喜食脆、硬食物（E错）也是对口腔的不良刺激，但通常不会长时间作用于某一部位，因此不成为口腔白色角化病的刺激因素。